治疗风湿性关节炎宜选用药物
A. 别嘌呤醇
B. 奎尼丁
C. 美沙酮
D. 氯氮平
E. 吲哚美辛

正确答案：E。吲哚美辛

解析：本题考查吲哚美辛。吲哚美辛（E对）是最强的PG合成酶抑制药，抗炎作用强，对炎性疼痛有明显的缓解作用，可用于风湿性关节炎的治疗；别嘌醇（A错）可用于痛风的治疗；奎尼丁（B错）是钠通道阻滞剂，用于心律失常；美沙酮（C错）为阿片受体激动剂，具有镇痛作用，不易产生耐受性和依赖性，可用于毒瘾戒断治疗；氯氮平（D错）为苯二氮䓬类抗精神病药。